男，11岁，因牙齿排列不齐要求正畸治疗，检查见前牙拥挤，如果拍片时发现颌骨体内边缘清楚的卵圆形致密影附着于下颌磨牙牙根部，周围可见环状密度减低的影像，应诊断为
A. 内生骨疣
B. 根尖囊肿
C. 真性牙骨质瘤
D. 致密性骨炎
E. 根尖肉芽肿

正确答案：C。真性牙骨质瘤

解析：本题考查成牙骨质细胞瘤。成牙骨质细胞瘤（C对）又称真性牙骨质瘤，多发生于10～29岁之间，X线可见附着于牙根部的边缘清楚的卵圆形致密影，周围环状密度减低。内生骨疣（A错）又称骨岛、特发性骨硬化症，是松质骨内一小块成熟的致密骨，以硬骨板和增厚的骨小梁为主，反映了在软骨内化骨过程中的发育错误。X线表现为骨髓腔内致密硬化区，边界清晰，周围无环状低密度影。根尖囊肿（B错）X线表现为根尖圆形透射影，边界清楚，有一圈阻射白线围绕。致密性骨炎（D错）X线表现为根尖部局限性的致密阻射影像，与正常骨分界不清。根尖肉芽肿（E错）X线表现为在根尖区圆形或卵圆形透射影，边界清楚。